儿童初次接种风疹疫苗的年龄是
A. 2个月
B. 3个月
C. 4个月
D. 6个月
E. 8个月

正确答案：E。8个月

解析：本题考查儿童初次接种风疹疫苗的年龄。新生儿风疹疫苗通常在8月龄（E对ABCD错）首次接种。接种一次后，95%的儿童可以产生抗体，获得足够的风疹病毒感染免疫力，这种免疫力可以维持至少15年。儿童上学或初中阶段，应再次加强，使体内抗体水平能长期保持，并能有效抵抗风疹病毒感染。